休克病人经充分扩容后血压相对平稳，此时宜选用何种药物改善微循环
A. 低分子右旋糖苷
B. 酚妥拉明
C. 多巴酚丁胺
D. 西地兰
E. 糖皮质激素

正确答案：B。酚妥拉明

解析：休克病人经充分扩容后血压相对稳定，最宜选用的改善微循环的药物是酚妥拉明（B对）。酚妥拉明作用机制为阻滞α受体，使血管平滑肌舒张，降低外周血管阻力，从而改善微循环。低分子右旋糖酐主要作用是扩充血容量（A错）。多巴酚丁胺和西地兰为强心药，主要是增强心肌收缩力（CD错）。糖皮质激素主要用于感染性休克和其他较严重的休克，也可以阻断α受体从而改善微循环，但其副作用较多，仅为改善微循环不宜应用（E错）。